下列可引起中枢性呕吐的是
A. 幽门梗阻
B. 洋地黄中毒
C. 急性腹膜炎
D. 急性心肌梗死
E. 迷路炎

正确答案：B。洋地黄中毒

解析：呕吐可分为中枢性呕吐、反射性呕吐及前庭障碍性呕吐。引起中枢性呕吐的是洋地黄中毒（B对）。幽门梗阻（A错）、急性腹膜炎（C错）、急性心肌梗死（D错）引起的呕吐为反射性呕吐。迷路炎（E错）引起的呕吐为前庭障碍性呕吐。